维生素D缺乏性佝偻病不易发生在哪个选项中
A. 长期奶糕喂养
B. 患儿偏食
C. 长期米粉喂养
D. 患儿消化吸收障碍
E. 单纯母乳或者牛奶喂养

正确答案：C。长期米粉喂养

解析：配方奶粉和米粉经强化维生素D处理，长期米粉喂养（C对）小儿可以获取充足的维生素D，不易发生维生素D缺乏性佝偻病。婴幼儿体内维生素D的来源有三个途径：①母体-胎儿的转运，这与婴幼儿的胎龄有关，即早产儿易发生维生素D缺乏；②食物中的维生素D：天然食物含维生素D很少，母乳含维生素D少，单纯母乳或者牛奶喂养（E错），易发生维生素D缺乏性佝偻病。患儿偏食（B错）和患儿消化吸收障碍（D错）容易造成摄入食物中的维生素D量减少，导致维生素D缺乏。奶糕的主要成分是面粉和糖类，维生素D含量很少，长期奶糕喂养（A错）亦可患维生素D缺乏性佝偻病。③皮肤的光照合成，是人类维生素D的主要来源。